宿主的固有免疫力的组成中，不包括
A. 屏障结构
B. 吞噬细胞
C. 细胞因子
D. 非特异性体液因素
E. 体液免疫

正确答案：E。体液免疫

解析：本题考查宿主的抗菌免疫及感染的发生发展。体液免疫（E错，为本题正确答案）不属于宿主的固有免疫力。宿主的固有免疫力，由屏障结构（A对），吞噬细胞（B对）、非特异性体液因素（D对）和细胞因子（C对）等组成。